以下哪项不是腺泡细胞癌的肿瘤实质细胞成分
A. 腺泡样细胞
B. 闰管样细胞
C. 空泡样细胞
D. 透明细胞
E. 篮细胞

正确答案：E。篮细胞

解析：腺泡细胞癌镜下见肿瘤实质细胞有腺泡样细胞、闰管样细胞、空泡样细胞、透明细胞和非特异性腺样细胞。而篮细胞是腺体的肌上皮细胞，不是腺泡细胞癌特有成分。掌握“腺泡细胞癌”知识点。